预防龋病的关键环节是
A. 控制菌斑
B. 控制糖的摄入
C. 氟化物的应用
D. 增强机体免疫力
E. 增强牙的抗龋能力

正确答案：A。控制菌斑

解析：本题考查龋病的预防。预防龋病的关键环节是控制菌斑（A对）。龋病是以细菌为主的多种因素影响下，牙体硬组织发生慢性进行性破坏的一种疾病。大量事实证明，细菌的的存在是龋病发生的先决条件，可以说没有牙菌斑就不会产生龋齿，故预防龋病的关键环节是控制菌斑。蔗糖及碳水化合物的致龋作用必须通过牙菌斑这一特定环境才有可能实现（B错）。氟化物的应用有助于已经存在的龋病釉质的再矿化，降低牙齿对龋病的敏感性，并干扰细菌代谢，从某种程度上减弱细菌的作用，但不是预防龋病的关键环节（C错）。人体自身免疫状态对龋病发病有重要影响，增强机体免疫力亦可影响龋病发病，但不会阻止龋病的发生（D错）。增强牙齿的抗龋能力主要是有效利用氟，并不能从根本上控制菌斑，故不是预防龋病的关键环节（E错）。